属于雌激素受体调节剂的药物有
A. 雷洛昔芬
B. 依降钙素
C. 甲羟孕酮
D. 雌三醇
E. 依普黄酮

正确答案：A、E。雷洛昔芬；依普黄酮

解析：本题考查雌激素受体调节剂。属于雌激素受体调节剂的药物有雷洛昔芬（A对）、依普黄酮（E对）。依降钙素（B错）为降钙素类药物。甲羟孕酮（C错）为孕激素的一种。雌三醇（D错）为雌激素的一种。